可用于治疗重度痤疮，但妊娠期妇女避免使用的药物是
A. 克拉霉素
B. 特比萘芬
C. 异维A酸
D. 克罗米通
E. 环吡酮胺

正确答案：C。异维A酸

解析：本题考查药物的禁忌症。异维A酸（C对）是痤疮治疗药，是维A酸的光学异构体，具有缩小皮脂腺，抑制皮脂腺活性，减少皮脂分泌，以及减轻上皮细胞分化和减少毛囊中痤疮丙酸杆菌的作用。妊娠期妇女口服异维A酸后可致自发性流产及胎儿发育畸形，应禁用。克拉霉素（A错）：对大环内酯类药物过敏者，孕妇，哺乳妇女，严重肝肾功能低下者，心律失常，心动过缓，Q-T间期延长,缺铁性心脏病，充血性心力衰竭及水电解质紊乱者禁用或慎用。特比萘芬（B错）：对盐酸特比萘芬及本品其它成份过敏者禁用。克罗米通（D错）：急性炎症性、糜烂或渗出性皮损处禁用；对本品过敏者禁用。环吡酮胺（E错）：对本品过敏者禁用。